公共场所“卫生许可证”的复核时间是
A. 每半年复核一次
B. 每年复核一次
C. 每三年复核一次
D. 每两年复核一次
E. 不定期

正确答案：D。每两年复核一次

解析：本题考查公共场所“卫生许可证”的复核时间。卫生许可证是卫生行政部门在开业之前，依据经营者申请进行预防性卫生监督之后，认为所经营的项目符合卫生标准和要求而制发的卫生许可证明书。公共场所卫生许可证有效期限为四年，每两年复核一次（D对ABCE错）。